女婴，8个月，哭闹、拒食、流涎。邻近磨牙的上腭和龈缘处见大面积浅表溃疡，上覆黄色假膜，偶见个别针头大小的小水疱。该患儿可能患有的疾病是
A. 疱疹样口疮
B. 过敏性唇炎
C. 雪口病
D. 扁平苔癣
E. 急性疱疹性龈口炎

正确答案：E。急性疱疹性龈口炎

解析：最常见的由Ⅰ型单纯疱疹病毒引起的口腔病损，可能表现为一种较严重的龈口炎——急性疱疹性龈口炎。①前驱期：原发性单纯疱疹感染，发病前常有接触疱疹病损患者的历史。潜伏期为4～7天，以后出现发热、头痛、疲乏不适、全身肌肉疼痛，甚至咽喉肿痛等急性症状，下颌下和颈上淋巴结肿大，触痛。患儿流唾液，拒食、烦躁不安。经过1～2天后，口腔黏膜广泛充血水肿，附着龈和龈缘也常出现急性炎症。②水疱期：口腔黏膜任何部位皆可发生成簇小水疱，似针头大小，特别是邻近乳磨牙（成人是前磨牙）的上腭和龈缘处更明显。水疱疱壁薄、透明，不久溃破，形成浅表溃疡。③糜烂期：尽管水疱较小，但汇集成簇，溃破后可形成大面积糜烂，并能造成继发感染，上覆黄色假膜。除口腔内的损害外，唇和口周皮肤也有类似病损，疱破溃后形成痂壳。④愈合期：糜烂面逐渐缩小，愈合，整个病程约需7～10天。但未经适当治疗者，恢复较缓慢。患病期间，抗病毒抗体在血液中出现，发病的14～21天最高，以后，抗体下降到较低的水平，虽可保持终生，但不能防止复发。掌握“口腔单纯疱疹”知识点。